转移性腹痛最常见的疾病是
A. 急性肠穿孔
B. 急性阑尾炎
C. 急性胃炎
D. 急性胰腺炎
E. 急性胆囊炎

正确答案：B。急性阑尾炎

解析：转移性腹痛最常见于急性阑尾炎，可见于约70%～80%的病人（B对）。急性肠穿孔（A错）主要表现为突发的腹痛，之后迅速出现腹膜炎体征。急性胃炎（C错）主要表现为中上腹不适、疼痛，腹痛多无特异性。急性胰腺炎（P457）（D错）多表现为左上腹疼痛，疼痛向左肩及左腰背部放射。急性胆囊炎（P443）（E错）主要表现为上腹部绞痛，疼痛向右肩、肩胛和背部放射。